上述内容体现医患沟通中医学目的需要的是
A. 良好的医患沟通保证了医学信息的可靠性和治疗手段的科学性
B. 疾病诊断的前提是对患者疾病起因发展过程的了解
C. 医疗活动的有效性和高质量，必须有医患双方的共同参与
D. 医患沟通体现了医疗活动中浓浓的人文情愫
E. 患者对医疗内容和方式的理解与医务人员不一致，容易导致医疗纠纷

正确答案：A。良好的医患沟通保证了医学信息的可靠性和治疗手段的科学性

解析：体现医患沟通中医学目的需要的是，良好的医患沟通保证了医学信息的可靠性和治疗手段的科学性。沟通交流是人际交往的基本方式，加强语言和非语言的密切沟通与交流，医务人员还要主动并正确使用沟通技术，以达到相互之间的了解、理解和发生矛盾时的宽容、谅解，从而可以保证了医学信息的可靠性和治疗手段的科学性（A对）。